患者，女，31岁，因“丙型病毒性肝炎”使用α-干扰素联合利巴韦林治疗。下列关于用药期间避孕和备孕措施的说法，正确的是
A. 干扰素、利巴韦林易引起畸胎或者胚胎致死效应，治疗期间和治疗后6个月内，必须采取避孕措施
B. 干扰素、利巴韦林较为安全，不必停药，即可备孕
C. 干扰素、利巴韦林较为安全，停药后即可备孕
D. 干扰素、利巴韦林较为安全，停药3个月后可备孕
E. 干扰素、利巴韦林易引起畸胎或者胚胎致死效应，停药3个月后可备孕

正确答案：A。干扰素、利巴韦林易引起畸胎或者胚胎致死效应，治疗期间和治疗后6个月内，必须采取避孕措施

解析：本题考查丙型病毒性肝炎用药期间避孕和备孕措施。干扰素、利巴韦林可引起畸胎或胚胎致死效应，故治疗期间和治疗后6个月内，所有育龄期妇女和男性均必须采取避孕措施（A对）。